治疗因体质虚弱所致的虚性晕厥，除主穴外应选用
A. 气海、关元
B. 风池、肾俞
C. 合谷、太冲
D. 合谷、内关
E. 素髎、内关

正确答案：A。气海、关元

解析：晕厥治宜苏厥醒神，以督脉及手厥阴经穴为主。主穴选用水沟、内关、涌泉。水沟属督脉穴，督脉入络脑，取之有开窍醒神之功；内关调心气，苏心神；涌泉可激发肾经之气，最能醒神开窍，多用于昏厥之重证。虚性晕厥配气海、关元。气海为人体先天元气聚会之处，男子生气之海，主一身气疾，因名气海，具有强壮作用。关元既主治中风脱证、虚劳冷惫、羸瘦无力等元气虚损病证，又为保健要穴（A对）。